哪种属于交感神经节
A. 椎旁节
B. 器官内节
C. 脊神经节
D. 器官旁节
E. 睫状神经节

正确答案：A。椎旁节

解析：交感神经节依其所在的位置可分为椎旁神经节（A对）和椎前神经节。周围部的副交感神经位于器官的周围或器官的壁内，称器官旁节（D错）和器官内节（B错）。脊神经节（C错）为感觉性神经节。